萜类的性质有
A. 可溶于水
B. 可溶于乙醚
C. 具有一定的芳香性
D. 有色
E. 母核具旋光性

正确答案：B、C、E。可溶于乙醚；具有一定的芳香性；母核具旋光性

解析：本题考查的是萜类化合物的理化性质。萜类的性质有可溶于乙醚（B对）、具有一定的芳香性（C对）与母核具旋光性（E对）。萜类化合物是一类由甲戊二羟酸衍生而成，基本碳架多具有2个或2个以上异戊二烯单位（C5单位）结构特征的不同饱和程度的衍生物。萜类极性较小，易溶与三氯甲烷、乙醚等亲脂性溶剂中，一般不易溶于极性大的水中（A错）。但环烯醚萜类化合物多连有极性官能团，故偏亲水性，易溶于水。单萜、倍半萜等一般具有芳香气味。环烯醚萜类化合物分子中C-1、C-5、C-8、C-9多形成手性碳原子，故多具有旋光性。一些萜类化合物为无色物质（D错），如链状倍半萜金合欢醇为无色油状液体。